除另有规定外，流浸膏剂的浓度为
A. 每100g相当于原药材200～500g
B. 每100ml中含被溶物85g
C. 每100ml相当于原药材100g
D. 每100ml相当于原药材20g
E. 每100ml相当于原药材10g（必要时根据其半成品中相关成分的含量加以调整）

正确答案：C。每100ml相当于原药材100g

解析：本题考查流浸膏的特点。除另有规定外，流浸膏剂的浓度为每100ml相当于原药材100g（C对）。流浸膏剂、浸膏剂特点：流浸膏剂、浸膏剂系指饮片用适宜的溶剂提取，蒸去部分或全部溶剂，调整至规定浓度而成的制剂。除另有规定外，流浸膏剂要求每1ml相当于饮片1g；浸膏剂分为稠膏和干膏两种，每1g相当于饮片2～5g（A错）。糖浆剂单糖浆特点：单糖浆，系蔗糖的饱和水溶液，浓度为85%（B错）（g/ml）或64.74%（g/g）。酊剂质量要求：除另有规定外，普通中药酊剂每100ml相当于原饮片20g（D错）。含有毒性药品的中药酊剂，每100ml应相当于原饮片10g；其有效成分明者，应根据其半成品的含量加以调整（E错），使符合各酊剂项下的规定；酊剂可用溶解、稀释、浸渍或渗漉等方法制备。